某男，38岁。因口腔溃疡、疼痛明显来医院就诊，兼见口渴、心烦、小便短赤、大便干结；查体：口腔黏膜多处溃疡，基底覆以黄苔，周围黏膜色红；舌红，苔黄腻，脉数有力。宜选用的中成药是
A. 加味逍遥丸
B. 当归龙荟丸
C. 清胃黄连丸
D. 连蒲双清片
E. 囗炎清颗粒

正确答案：C。清胃黄连丸

解析：本题考查口疮之心脾积热证的中成药应用。患者为口疮之心脾积热证，宜选用的中成药是清胃黄连丸（C对）。口疮之心脾积热证【症状】口腔黏膜溃疡，灼痛明显，常因过食煎炒辛辣或少寐而发，伴口渴心烦、失眠、小溲短黄、大便秘结；检查见口腔黏膜表面有黄白色假膜，周边红肿。舌红，苔黄或腻，脉数有力。【中成药应用】常用中成药牛黄清胃丸、导赤丸、清胃黄连丸。郁证之肝气郁结证【症状】精神抑郁，情绪不宁，胸部满闷，胁肋胀痛，痛无定处，胸闷嗳气，喜太息，不思饮食，大便不调，或秘或溏泄。舌苔薄或腻，脉弦。【中成药应用】常用中成药逍遥丸（A错）（水丸）、丹栀逍遥丸、越鞠丸。当归龙荟丸（B错）【主治】泻火通便的功效。用于肝胆火旺，心烦不宁，头晕目眩，耳鸣耳聋，胁肋疼痛，脘腹胀痛，大便秘结。泄泻之湿热伤中证【症状】泄泻腹痛，泻下急迫，势如水注，或泻而不爽，粪色黄褐，气味臭秽，肛门灼热，烦热口渴，小便短黄。舌质红，苔黄腻，脉滑数或濡数。【中成药应用】肠康片、香连片、痢必灵片（糖衣片）、泻痢消胶囊、连蒲双清片（D错）、白蒲黄片。囗炎清颗粒（E错）【主治】用于阴虚火旺所致的口腔炎症。